有关游离皮片移植的下列描述，正确的是
A. 皮片愈薄，生长能力愈差
B. 全厚皮片较刃厚皮片移植后易收缩
C. 全厚皮片耐磨及负重，但色泽变化也大
D. 有感染的肉芽伤面，只能采用全厚皮片移植
E. 口腔内植皮，多采用薄中厚皮片

正确答案：E。口腔内植皮，多采用薄中厚皮片

解析：本题考查游离皮片移植。薄中厚皮片因术后收缩小，故多用于口腔黏膜缺损修复（E对）。游离皮片分为表层皮片（刃厚皮片）、中厚皮片以及全厚皮片三种。表层皮片最薄，移植后生活能力强，抗感染能力强，能生长在有感染的肉芽创面上，皮片愈薄生长能力愈强（A错）。有感染创面只能用表层皮片（D错）。正是因为薄，所以收缩大，极易挛缩，故全厚皮片较刃厚皮片移植后收缩小（B错），全厚皮片有弹性、能耐磨擦和负担重力，色泽变化不大（C错），故在面部多用。